寡免疫复合物型新月体性肾炎最常见的血清学指标变化是
A. 单克隆免疫球蛋白升高
B. 抗中性粒细胞胞浆抗体阳性
C. 抗肾小球基底膜抗体阳性
D. 抗核抗体阳性
E. 补体下降

正确答案：B。抗中性粒细胞胞浆抗体阳性

解析：寡免疫复合物型新月体性肾炎即少免疫复合物型、Ⅲ型急进型肾炎，其最常见的血清学指标变化是抗中性粒细胞胞浆抗体（ANCA）阳性（B对）。抗肾小球基底膜抗体阳性（C错）是抗肾小球基底膜型肾炎（I型急进型肾炎）常见的血清学指标变化（P467）。抗核抗体阳性（D错）对风湿性疾病的诊断有帮助。单克隆免疫球蛋白（A错）升高见于单克隆免疫球蛋白血症，主要表现为肾小球肾炎，主要症状为疲乏无力、食欲减退。